用于口腔黏膜消毒、冲洗伤口、防止厌氧菌感染试剂为
A. 3%～6%的过氧化氢
B. 0.2%～0.3%过氧乙酸
C. 10%甲醛溶液
D. 75%乙醇溶液
E. 10%～20%漂白粉上清液

正确答案：A。3%～6%的过氧化氢

解析：3%～6%过氧化氢，用于口腔黏膜消毒，冲洗伤口防止厌氧菌感染。掌握“消毒与灭菌”知识点。